语言謇涩，病因多属
A. 热扰心神
B. 痰火扰心
C. 风痰阻络
D. 心气不足
E. 心阴大伤

正确答案：C。风痰阻络

解析：热扰心神多致谵语（A错）。痰火扰心多致谵语或狂言（B错）。言謇指神志清楚、思维正常而吐字困难，或吐字不清，多因风痰阻络所致（C对）。心气不足多致独语或错语（D错）。心阴大伤可致心悸失眠，一般不会导致病态语言。（E错）。